根据治崩三法，应首选的是
A. 塞流
B. 澄源
C. 复旧
D. 调经为本
E. 塞流，澄源并进

正确答案：E。塞流，澄源并进

解析：阴血亏虚，冲任失守，故出现非时暴下，阴虚内热，故经色鲜红，质稠，阴虚内热，热扰心神，故心烦，舌红苔黄脉细数均为阴虚之象，治疗当养阴清热，固冲止血，即止血与求因之本并用（E对）。患者月经非时暴下，量多如崩，处于暴崩之际，急当止血防脱，塞流即指止血，止血后需求因之本（A错）。澄源即正本清源，是治疗崩漏的重要阶段，用于出血缓解后的辩证论治（B错）。复旧即固本善后，是巩固崩漏治疗的重要阶段，用于止血后的恢复阶段（C错）。崩漏的治疗原则为急则治其标，患者处于暴崩之际，不应先调经（D错）。